男，40岁。干农活时刺伤右足10天，伤后未就医，张口困难2天，颈项紧，频繁抽搐，呼吸道分泌物较多，有窒息的危险，为保持呼吸道的通畅。最有效的措施是
A. 气管切开
B. 协助抬背咳痰
C. 环甲腺穿刺
D. 气管插管
E. 吸痰

正确答案：A。气管切开

解析：患者10天前干农活时刺伤右足，伤后未就医，张口困难2天，颈项紧，频繁抽搐，大量呼吸道分泌物，考虑破伤风。破伤风是常和创伤相关联的一种特异性感染，主要发病因素是缺氧环境。约90%的病人在受伤后2周内发病，典型症状是在肌紧张性收缩（肌强直、发硬）的基础上，阵发性强烈痉挛，出现张口困难（牙关紧闭）、蹙眉、口角下缩、咧嘴“苦笑”颈部强直、头后仰等症状，膈肌受影响后，发作时面唇青紫，通气困难，可出现呼吸暂停。根据创伤史和典型临床表现，可诊断破伤风。患者呼吸道分泌物较多，呼吸困难，需要尽快进行气管切开（A对），既可解除呼吸道梗阻，又能清除呼吸道分泌物。抬背咳痰（B错）和吸痰（E错）为清除呼吸道分泌物，由于患者存在强烈的肌肉痉挛，因此无法解除呼吸道梗阻。环甲膜穿刺（C错）和气管插管（D错）均可一定程度清除分泌物，减轻梗阻，但是效果均没有气管切开彻底。